患者右上第一磨牙牙髓治疗后劈裂，拔牙过程中，腭根进入上颌窦，经去除牙槽间隔后扩大牙槽窝将其冲出，此时上颌窦约7mm大小的穿孔，患者最佳的处理方法是
A. 立即行上颌窦瘘修补术
B. 拔牙后常规处理，待其自然愈合
C. 牙槽窝填塞碘仿纱条
D. 拔牙后常规处理，将两侧牙龈拉拢后缝合
E. 按干槽症治疗方法处理

正确答案：A。立即行上颌窦瘘修补术

解析：由于上颌窦发育过大，牙根尖接近窦底，拔牙时可造成上颌窦底穿孔，小者血凝块充填，可自行愈合；大者或上颌窦原有炎症，常发生上颌窦瘘。应及时清除窦腔内残留牙根与异物，待炎症消退后，行口腔上颌窦瘘修补术。掌握“牙槽外科”知识点。